连接上颌两侧同名磨牙的颊尖、舌尖形成一条凸向下的曲线
A. 上颌牙列的纵（牙合）曲线
B. 下颌牙列的纵（牙合）曲线
C. 上颌牙列的横（牙合）曲线
D. 下颌牙列的横（牙合）曲线
E. 补偿曲线

正确答案：C。上颌牙列的横（牙合）曲线

解析：横（牙合）曲线又称Wilson曲线。上颌两侧磨牙在牙槽中的位置均略向颊侧倾斜，使舌尖的位置低于颊尖，因此，连接两侧同名磨牙的颊尖、舌尖形成一条凸向下的曲线，称横（牙合）曲线。同样，在下颌可以形成凹向上的横（牙合）曲线。虽然下颌磨牙向舌侧倾斜，但其舌尖较高，故横（牙合）曲线不很明显。掌握“牙列”知识点。